可分为颈内动脉和颈外动脉的是
A. 颞浅动脉
B. 喉上神经
C. 舌下神经
D. 面总静脉
E. 颈总动脉

正确答案：E。颈总动脉

解析：颈总动脉：在颈动脉三角的下部，从胸锁乳突肌的前缘露出，沿气管及喉的外侧上行，约平甲状软骨上缘处，分为颈内动脉和颈外动脉。掌握“气管颈段、颈动脉三角的解剖特点及临床应用”知识点。